细菌性痢疾的渗出和坏死物形成
A. 伪膜
B. 化生
C. 渗出
D. 转化
E. 增生

正确答案：A。伪膜

解析：细菌性痢疾是由痢疾杆菌引起的假膜性炎，其渗出和坏死物可形成一层灰白色膜状物，即伪膜（假膜）（A对）。